男，59岁。发现右侧阴囊内肿物5年，逐渐增大。肿物呈球形，表面光滑，有囊性感，无压痛，触不到睾丸和附睾。透光试验阳性。B超示液性暗区。平卧后肿物无消失或缩小。最可能的诊断是
A. 腹股沟斜疝
B. 附睾炎
C. 精索囊肿
D. 睾丸鞘膜积液
E. 睾丸肿瘤

正确答案：D。睾丸鞘膜积液

解析：患者中年男性，右侧阴囊内肿物5年，逐渐增大。肿物呈球形，表面光滑（排除恶性肿瘤），有囊性感，无压痛，触不到睾丸和附睾。透光试验阳性。B超示液性暗区（内容物为液性）。平卧后肿物无消失或缩小。睾丸鞘膜积液（D对）呈球形或卵圆形，表面光滑，有弹性和囊样感，无压痛，触不到睾丸和附睾。透光试验阳性，即在暗室内用黑色纸筒罩于阴囊，手电筒由阴囊肿物下方向上照射，积液有透光性，超声呈液性暗区（P582）。腹股沟斜疝的肿大阴囊，平卧位时阴囊内容物可回纳，透光试验亦呈阴性（A错）。附睾炎有附睾增厚或肿大，与睾丸界限清楚，透光试验阴性（B错）（P542）精索囊肿常位于腹股沟和睾丸上方，积液的鞘膜囊与睾丸有明显分界，可触到睾丸和附睾（C错）。睾丸肿瘤为实质性肿块质地坚硬，患侧睾丸有沉重感，透光实验呈阴性（E错）。